女性，40岁。便秘10余年，加重半年，排便需要刺激性泻药，且伴左下腹腹胀，排出粪便后可缓解，进食量较前减少，体重有所增加。纤维结肠镜检査未见异常，因此考虑肠易激综合征，但还需除外
A. 结肠癌
B. 甲状腺功能减低症
C. 结肠冗长
D. 先天性巨结肠
E. 习惯性便秘

正确答案：B。甲状腺功能减低症

解析：该患者纤维结肠镜检查未见异常，可除外结肠癌、结肠冗长及先天性巨结肠。甲状腺功能减低症也可导致腹胀、便秘，严重者出现麻痹性肠梗阻，该患者还有进食量减少、体重增加等表现，需除外甲状腺功能减低症所致便秘。掌握“肠易激综合征”知识点。